某女患头痛数月，遇上感和月经来潮时疼痛加重，于是出于彻底检查的目的来院坚决要求作CT检查，被医师拒色。医师开出脑电图检查单和请耳鼻喉科会诊单。病人大为不满。为形成正常医患关系，该医师应该
A. 维持契约关系，完全按病人要求办，开单作CT检查
B. 维持契约关系，坚决按医生意见办，脑电图检查后
C. 维持契约信托关系，说服患者先行体格检查再定
D. 维持信托关系，对不信赖者拒绝接诊
E. 维持信托关系，先查CT和脑电图、进行会诊，然后体检

正确答案：C。维持契约信托关系，说服患者先行体格检查再定